影响药物制剂稳定性的因素包括
A. 温度
B. 光线
C. 空气
D. 金属离子
E. 湿度

正确答案：A、B、C、D、E。温度；光线；空气；金属离子；湿度

解析：本题考查影响药物制剂稳定性的因素。影响药物制剂稳定性的因素包括处方因素和外界因素。其中，外界因素有（1）温度的影响（A对）：一般来说，温度升高，反应速度加快。（2）光线的影响（B对）：光是一种辐射能，光线的波长越短，能量越大，光线提供的能量可激发氧化反应，加速药物的降解。（3）空气（氧）的影响（C对）：大气中的氧是引起药物氧化变质的重要因素。大多数药物的氧化反应往往是含自由基的自氧化反应，少量的氧就能引发反应的开始。（4）金属离子的影响（D对）：微量金属离子对自氧化反应有明显的催化作用。（5）湿度和水分的影响（E对）：空气湿度与物料含水量对固体药物制剂的稳定性有较大影响，水是化学反应的媒介，固体药物吸附了水分以后，在表面形成一层液膜，分解反应就在液膜中进行。